进行病因学研究时，可采用描述性研究或实验性研究，这两种方法的区别在于，实验性研究中
A. 实验组和对照组的暴露情况是自然存在的
B. 由实验者决定哪个组暴露于可疑因素，哪个组作对照
C. 实验组和对照组的样本大小相等
D. 该研究是回顾性的
E. 该研究需设立对照组

正确答案：B。由实验者决定哪个组暴露于可疑因素，哪个组作对照